患儿，男，8岁，排便时肛门脱出一肿物，呈环形，色鲜红，便后自行回纳，有时伴有点滴出血，多染于便纸上。可能的诊断是
A. 内痔脱出
B. 息肉脱出
C. 完全性直肠脱垂
D. 直肠粘膜脱垂
E. 血栓性外痔

正确答案：D。直肠粘膜脱垂

解析：患者排便时肛门脱出环状肿物，便后能自行回纳，出血量少，仅拭纸有血，符合Ⅰ度脱垂（直肠黏膜脱出），脱出物淡红色，长3～5cm，触之柔软，无弹性，不易出血，便后可自行回纳（D对）。Ⅱ度脱垂（直肠全层脱出），脱出物长5～10cm，呈圆锥状，淡红色，表面为环状而有层次的黏膜皱襞，触之较厚，有弹性，肛门松弛，便后有时需用手回复（C错）。内痔便后亦会脱出，痔核脱出颜色暗红或青紫，呈颗粒状，各痔核间有明显的分界（A错）。位置较高的小息肉一般无症状；低位带蒂息肉，大便时可脱出肛门外，小的能自行回纳，大的便后需用手推回，常伴有排便不畅、下坠，或有里急后重感。多发性息肉常伴腹痛、腹泻，排出血性黏液便，久之则体重减轻、体弱无力、消瘦、贫血等（B错）。血栓性外痔多发生于肛门左右两侧，突然肿起，形如葡萄，色青紫，按之较硬，光滑，疼痛剧烈（E错）。